为避免修复体戴入后出现医生与患者之间的分歧，修复前需了解和评价的内容不包括
A. 修复动机
B. 具体要求
C. 对修复的期望值
D. 社会医学有关因素
E. 患者的家庭关系

正确答案：E。患者的家庭关系

解析：本题考查医患沟通。为避免修复体戴入后出现医生与患者之间的分歧，修复前需了解和评价的内容不包括患者的家庭关系（E错，为本题正确答案）。为避免修复体戴入后出现医生与患者之间的分歧，修复前需了解和评价患者的修复动机（A对）、具体要求（B对）、对修复的期望值（C对）和社会医学有关因素（D对）。